大黄泻下作用的主要有效成分是
A. 番泻苷A
B. 阿魏酸
C. 小檗碱
D. 单宁酸
E. 大黄素

正确答案：A。番泻苷A

解析：本题考查的是大黄的药理作用。大黄泻下作用的主要有效成分是番泻苷A（A对）。从大黄中分离得到蒽醌、二蒽酮、芪、苯丁酮、单宁（D错）、萘色酮等不同种类的80多种化合物，大体上可分为蒽醌类、多糖类与鞣质类。其中蒽醌类及其衍生物含量为3%～5%，分为游离型与结合型。《中国药典》以总蒽醌和游离蒽醌为指标成分，采用高效液相色谱法测定药材和饮片中芦荟大黄素、大黄酸、大黄素、大黄酚和大黄素甲醚等总蒽醌的含量，要求药材总蒽醌不得少于1.5%，游离蒽醌不得少于0.20%。大黄的药理作用：（1）泻下：大黄泻下作用明确，致泻的主要成分为结合型蒽醌苷，其中以二蒽酮苷中的番泻苷泻下作用最强。大黄酸蒽酮具有胆碱样作用，可兴奋肠平滑肌上M胆碱受体，促进结肠蠕动；大黄酸蒽酮抑制肠平滑肌细胞膜上Na⁺-K⁺-ATP酶，抑制Na⁺从肠腔转移至细胞内，使肠腔内渗透压升高，H₂O、Na⁺滞留，使肠腔容积扩大，机械性刺激肠壁，使肠蠕动增强而致泻。（2）抗菌：大黄酸、大黄素（E错）具有抗菌作用，大黄煎剂及其水、醇、醚提取物在体外对一些致病真菌有抑制作用。（3）抗炎：大黄煎剂对多种炎症动物模型均有抗炎作用，对炎症早期的渗出、水肿和炎症后期的结缔组织增生均有明显的抑制作用。（4）止血：大黄止血的有效成分主要有大黄酚、儿茶素和没食子酸等。阿魏酸（B错）为当归含量测定的指标成分。当归有机酚酸的化学结构：当归中主要含有机酸类成分、挥发油和多糖类成分。有机酸类成分主要包括阿魏酸、香草酸、烟酸和琥珀酸等。《中国药典》以阿魏酸和挥发油为指标成分进行含量测定，要求阿魏酸含量不得少于0.050%，挥发油含量不得少于0.4%（ml/g）。阿魏酸时当归抗心肌缺血的有效成分。小檗碱（C错）为黄连含量测定的指标成分。黄连的有效成分主要是生物碱，已经分离出来的生物碱有小檗碱（含量最高）、巴马汀、黄连碱、甲基黄连碱、药根碱和木兰碱（属于阿朴菲型）等；大多属苄基异喹啉类衍生物，季铵型生物碱。《中国药典》以小檗碱为指标成分进行含量测定。以盐酸小檗碱计，要求味连含小檗碱不得少于5.5%，表小檗碱不得少于0.80%，黄连碱不得少于1.6%，巴马汀不得少于1.5%；要求雅连含小檗碱不得少于4.5%；要求云连含小檗碱不得少于7.0%。黄连有抗菌、抗病毒、抗毒素、抗腹泻、解热、抗炎、降血压等药理作用。